发绀多见于（）中毒
A. 酒精
B. 阿托品
C. 一氧化碳
D. 亚硝酸盐
E. 毒蕈

正确答案：D。亚硝酸盐